激素避孕使用的药物成分主要是
A. 雄激素
B. 醛固酮
C. 胰岛素
D. 促性腺激素释放激素
E. 雌激素

正确答案：E。雌激素

解析：激素避孕使用的成分是雌激素和孕激素。掌握“激素避孕”知识点。